下列不属于白芍功效的是
A. 养血调经
B. 敛阴止汗
C. 柔肝止痛
D. 补气养阴
E. 平抑肝阳

正确答案：D。补气养阴

解析：白芍味苦、酸，性微寒，归肝、脾经，具有养血调经，敛阴止汗，柔肝止痛，平抑肝阳的功效(D错，为本题正确答案)。酸寒敛阴，苦寒泻热，入肝经，既补肝，又泻肝；入营分，养肝血，能缓解筋脉痉挛，止疼痛。常用于治疗血虚痿黄，月经不调，自汗，盗汗，胁痛，腹痛，四肢挛痛，头痛眩晕。